下列龋病类型哪种是按损害程度分类的
A. 急性龋
B. 慢性龋
C. 中龋
D. 静止龋
E. 窝沟龋

正确答案：C。中龋

解析：本题考查龋病的分类。按损害程度分类，龋病可分为浅龋、中龋（C对）、深龋。按发病情况和进展速度分类，可分为急性龋（A错）、慢性龋（B错）、静止龋（D错）、继发龋。按损害的解剖部位分类，可分为窝沟龋（E错）、平滑面龋、根面龋、线形釉质龋、隐匿性龋。